可加重心脏负性肌力和心力衰竭的药品是
A. 地西泮
B. 普萘洛尔
C. 利福平
D. 苯乙胺
E. 维拉帕米

正确答案：E。维拉帕米